食物脂肪消化吸收后进入血液的主要方式是
A. 甘油及FA
B. DG及FA
C. MG及FA
D. CM
E. TG

正确答案：D。CM